胆汁中与脂肪消化关系密切的成分是
A. 胆固醇
B. 磷脂酰胆碱（卵磷脂）
C. 胆色素
D. 胆盐
E. 脂肪酸

正确答案：D。胆盐